仅用于预防支气管哮喘发作宜选用的药物是
A. 克仑特罗
B. 色甘酸钠
C. 可待因
D. 氨茶碱
E. 二丙酸倍氯米松

正确答案：B。色甘酸钠

解析：本题考查预防支气管哮喘的药物种类。色甘酸钠（B对）临床用于预防哮喘发作，包括过敏性哮喘和慢性哮喘等。